患者，女，28岁。产后1周突然出现左小腿肿胀，疼痛，皮温增高，浅静脉怒张，足背弯曲时腓肠肌疼痛明显，舌暗淡苔黄腻，脉弦滑。其治法是
A. 活血化瘀，温阳通脉
B. 活血化瘀，清利湿热
C. 活血化瘀，温阳利水
D. 活血化瘀，通络止痛
E. 活血化瘀，消肿止痛

正确答案：B。活血化瘀，清利湿热

解析：股肿是指血液在深静脉血管内发生异常凝固而引起的静脉阻塞、血液回流障碍的疾病，其主要表现为肢体肿胀、疼痛、局部皮温升高和浅静脉怒张四大症状，好发于下肢髂股静脉和腘静脉，可并发肺栓塞而危及生命，相当于西医的深静脉血栓形成，本病例临床表现符合股肿的四大症状，故诊断为股肿，是由于产后肢体气机不利，气滞血瘀于经脉之中，营血回流不畅而起。舌暗淡为血瘀之象；苔黄腻，脉弦滑，为湿热内盛之象，本病例的证型为湿热下注，治法宜活血化瘀，清利湿热（B对）。活血化瘀，温阳利水适用于气虚血瘀，寒湿凝滞证（C错）。活血化瘀，通络止痛适用于血脉瘀阻证（D错）。活血化瘀，温阳通脉和活血化瘀，消肿止痛不是本病例的治法（AE错）。